女，25岁。停经48天，1个月前曾不正规服用过探亲避孕片。现阴道少量出血5天，伴腹痛，B超示宫内早孕，下列哪项为最佳处理方案
A. 注射黄体酮
B. 注射绒毛膜促性腺激素
C. 吸宫术终止妊娠
D. 中药安胎
E. 注射催产素

正确答案：C。吸宫术终止妊娠

解析：本例1个月前曾不正规服用过探亲避孕片，在服药的情况下发生了妊娠，存在药物引起胚胎畸形的可能，又出现了先兆流产的征象，以终止妊娠为宜。掌握“自然流产”知识点。